下列哪项属于食品安全重点监督管理的内容
A. 进入生产经营场所实施现场检查
B. 查阅、复制有关合同、票据、账簿以及其他有关资料
C. 对生产经营的食品、食品添加剂、食品相关产品进行抽样检验
D. 保健食品生产过程中的添加行为
E. 查封违法从事生产经营活动的场所

正确答案：D。保健食品生产过程中的添加行为